关于带状疱疹治疗的说法，正确的有
A. 在发疹后24～72小时内开始使用抗病毒药物疗效最佳
B. 抗病毒治疗的疗程通常为7天
C. 疱疹未破时，可外用炉甘石洗剂
D. 疱疹破溃时，可酌情用莫匹罗星软膏
E. 对轻至中度疼痛，建议首选阿片类药物

正确答案：A、B、C、D。在发疹后24～72小时内开始使用抗病毒药物疗效最佳；抗病毒治疗的疗程通常为7天；疱疹未破时，可外用炉甘石洗剂；疱疹破溃时，可酌情用莫匹罗星软膏

解析：本题考查带状疱疹治疗。带状疱疹的抗病毒治疗应在发疹后24～72小时内开始使用，以迅速达到并维持有效血药浓度，获得最佳治疗效果（A对）。疗程通常为7天（B对）。疱疹未破可外用0.25%炉甘石洗剂（C对）或阿昔洛韦软膏或喷昔洛韦乳膏。疱疹破溃时，可酌情用3%硼酸溶液或1：5000呋喃西林溶液湿敷，或外用0.5%新霉素软膏或2%莫匹罗星软膏（D对）等。轻至中度疼痛可给予对乙酰氨基酚、布洛芬或曲马多；中至重度疼痛使用阿片类药物（E错）或治疗神经病理性疼痛的药物（如卡马西平、加巴喷丁、普瑞巴林）。